阴阳失调指
A. 阳胜则阴病
B. 阳损及阴
C. 二者均是
D. 二者均非

正确答案：C。二者均是

解析：本题考查的是阴阳失调的内容。阴阳失调指阳胜则阴病与阳损及阴（C对）。阴阳失调，即是阴阳消长失去平衡协调的简称。是指机体在疾病的发生发展过程中，由于各种致病因素的影响，导致机体阴阳消长失去相对的平衡，从而形成阴阳偏盛、偏衰，或阴不制阳、阳不制阴的病变状态。阳胜则阴病属于阳盛。“阳胜则阴病”，即阳盛则阴虚。但从病机上必须区分阴的虚损程度。邪客于阳而致阳盛，此时由于阴的相对不足，从而出现实热证。如果由于阳盛而耗伤机体的阴液，此时阴由相对的不足转而成为绝对的虚亏，这就从实热证转化为虚热证或实热兼阴亏证。阳损及阴属于阴阳互损。阳损及阴，是指由于阳气虚损，无阳则阴无以生，从而在阳虚的基础上又导致了阴虚，形成以阳虚为主的阴阳两虚的病机变化。